统计表的主语通常放在统计表
A. 下面
B. 上面
C. 左侧
D. 右侧
E. 中间

正确答案：C。左侧